将一个问卷分拆为两半，分别作为各自的复本的是
A. 复测信度
B. 复本信度
C. 准则效度
D. 内容效度
E. 折半信度

正确答案：E。折半信度